西洋参的功效是
A. 补气，生津
B. 补气，活血
C. 补气，固表
D. 补气，利尿
E. 补气，养血

正确答案：A。补气，生津

解析：本题考查西洋参的功效。西洋参的功效是补气，生津（A对）。西洋参【功效】补气养阴，清热生津。刺五加【功效】补气健脾，益肾强腰，养心安神，活血（B错）通络。黄芪【功效】补气升阳，益卫固表（C错），托毒生肌，利水消肿。黄芪、白术，均性偏温，为温补兼利水之品，同能补气利尿（D错）、固表止汗，治脾虚气弱，水湿内停之水肿、小便不利，以及气虚自汗。党参【功效】补中益气，生津养血（E错）。